铅的主要蓄积部位是
A. 骨骼
B. 肾脏
C. 肝脏
D. 骨髓
E. 神经组织

正确答案：A。骨骼

解析：铅是一种积累性毒物，机体可通过食物摄取铅，也能从污染的空气中摄取铅，侵入人体的铅70%～90%最后以磷酸铅的形式沉积并附着于骨骼组织（A对）上。